中国药典规定“熔点”系指
A. 固体初熔时的温度
B. 固体全熔时的温度
C. 供试品在毛细管中收缩时的温度
D. 固体熔化时自初熔至全熔时的一段温度
E. 供试品在毛细管中开始局部液化时的温度

正确答案：D。固体熔化时自初熔至全熔时的一段温度